下列各项哪一项不是抗力形所要求的
A. 窝洞应底平，壁直，点线面清楚而圆钝
B. 窝洞的深度应达到釉牙本质界下0.5mm
C. 洞形外形线圆缓
D. 使用根管桩或牙本质钉
E. 鸠尾峡与轴髓线角勿在同一平面上

正确答案：D。使用根管桩或牙本质钉

解析：本题考查抗力形的要求。使用根管桩或牙本质钉（D错，为本题的正确答案）不是抗力形所要求的。根管桩和牙本质钉为辅助固位形。盒状洞形底平壁直，点线面清楚而圆钝，使咬合力均匀的分布，避免应力集中（A对）。窝洞必需有一定深度，使充填体有足够的厚度，从而具有一定强度，一般要求窝洞的深度应达到釉牙本质界下0.2～0.5mm（B对）。窝洞外形呈圆缓曲线，圆缓的外形有分散应力的作用（C对）。鸠尾峡与轴髓线角不在同一平面，避免峡部应力集中而折断（E对）。